心身疾病是
A. 心理社会因素在病因上引起主导作用的躯体疾病
B. 由心理社会因素引起的精神疾病
C. 由心理社会因素引起的器官系统的功能性改变
D. 由心理社会因素引起的神经症
E. 由心理社会因素引起的生理反应

正确答案：A。心理社会因素在病因上引起主导作用的躯体疾病

解析：此题为概念题。心身疾病是精神刺激引起的器质性病变，是心理社会因素在病因上引起主导作用的躯体疾病（A对）。心身疾病的特点是：以躯体症状为主，有明确的病理生理过程：某种个性特征是疾病发生的易患素质：疾病的发生和发展与心理社会应激（如生活事件等）和情绪反应有关：生物或躯体因素是某些心身疾病的发病基础，心理社会因素往往起“扳机”作用：心身疾病通常发生在自主神经支配的系统或器官：心身综合治疗比单用生物学治疗效果好。